在外感咳嗽中，病程缠绵，久则导致肺阴亏耗的是
A. 风寒
B. 风热
C. 暑湿
D. 风燥
E. 风湿

正确答案：D。风燥

解析：外感咳嗽病浅，容易治愈，但是燥和湿邪致病时较为缠绵。风燥之邪虽有温凉之分，仍以燥邪化热者多。燥热袭肺，最易灼伤肺阴，尤其炽热延久，病程缠绵时，肺阴损伤更是严重。（D对ABCE错）。